一侧肾结核无功能，对侧肾正常，应作
A. 抗结核治疗
B. 病灶清除术
C. 肾部分切除术
D. 肾切除术
E. 肾造瘘术

正确答案：D。肾切除术

解析：若一侧肾结核无功能，对侧肾正常，应行患肾切除术（D对）。抗结核治疗（A错）主要用于肾结核的早期治疗；病灶清除术（B错）适用于肾实质表面闭合性的、与集合系统不相通的局灶性结核脓肿；肾部分切除术（C错）适用于结核病灶局限于肾的一极的患者；肾造瘘术（E错）主要用于患肾功能丧失、对侧肾积水严重的患者。